对三种医德评价方式相互关系的正确理解是
A. 相辅相成、互相补充
B. 完全一致、可以替代
C. 互相冲突、都不可信
D. 比较混乱、说不清楚
E. 以上都不是

正确答案：A。相辅相成、互相补充